某男，20岁，因饮食不洁导致痢疾，症见大便脓血里急后重，发热腹痛，舌淡红，苔黄腻，脉滑数。医师诊为大肠湿热，处方为黄连、木香，水煎服。为增强上方止痢止泻，拟在方中加用清热解毒，凉血止痢之品，宜选用
A. 龙胆
B. 熊胆
C. 紫草
D. 白鲜皮
E. 白头翁

正确答案：E。白头翁

解析：本题考查的是白头翁的功效。为增强上方止痢止泻，拟在方中加用清热解毒，凉血止痢之品，宜选用白头翁（E对）。白头翁：【功效】清热解毒，凉血止痢。龙胆（A错）：【功效】清热燥湿，泻肝胆火。紫草（C错）：【功效】凉血活血，解毒透疹。白鲜皮（D错）：【功效】清热解毒，祛风燥湿，止痒。熊胆（B错）的功效，2022年考试指南未明确说明。熊胆：【功效】清热解毒，明目，止痉。